青少年心身发展的特点不包括
A. 体质发育快，生理功能不断成熟
B. 认知功能全面和均衡发展
C. 情绪体验敏感而稳定
D. 人格逐渐形成
E. 性心理不断成熟

正确答案：C。情绪体验敏感而稳定